炒苍耳子宜用的火候是
A. 大火
B. 小火
C. 中火
D. 武火
E. 文火

正确答案：C。中火

解析：本题考查的是炒法的火力。炒苍耳子宜用的火候是中火（C对）。苍耳子：【炮制方法】处方用名有苍耳子、炒苍耳子。①苍耳子：取原药材，除去杂质，用时捣碎。②炒苍耳子：取净苍耳子，置炒制容器内，用中火加热，炒至黄褐色，刺焦时即可，碾去刺，筛净。用时捣碎。火力是指药物炮制过程中所用热源释放出的热量大小、火的强弱或温度的高低。火力可分为文火、中火、武火。文火（E错）即小火（B错），武火（D错）即大火（A错）或强火，介于文火和武火之间的是中火。先文火后武火，或文火和武火交替使用的为文武火。文火一般用于炒黄，中火一般用于炒黄、炒焦，武火一般用于炒焦、炒炭。